男，52岁。公司经理，吸烟10年，每天2包。应该建议该就诊者采取的预防措施是
A. 流感疫苗接种
B. 肺炎链球菌疫苗接种
C. 戒烟，适当运动、合理饮食
D. 冬令进补
E. 冷水沐浴锻炼

正确答案：C。戒烟，适当运动、合理饮食

解析：吸烟可使血中高密度脂蛋白含量下降，血清胆固醇含量增高，可使动脉粥样硬化的发病率和病死率较不吸烟者增高2～6倍（P221）。本例患者为中老年男性，长期吸烟史（20年），且每日吸烟支数较多，都是发生动脉粥样硬化的危险因素。故就诊者采取的预防措施是主要是预防动脉粥样硬化的发生。一般的防治措施包括戒烟，适当运动、合理饮食等（C对）。流感疫苗接种（A错）用于预防流行性感冒。肺炎链球菌疫苗接种（B错）用于预防肺炎链球菌导致的肺炎。冬令进补（D错）和冷水沐浴（E错）锻炼主要是以提高营养，锻炼身体为主，与动脉粥样硬化的预防无关。